放射诊疗工作场所应当设有电离辐射警告标志的地方是
A. 挂号处
B. 入口处
C. 预检处
D. 监督处
E. 候诊处

正确答案：B。入口处

解析：《放射诊疗管理规定》，医疗机构应当对下列设备和场所设置醒目的警示标志：1)装有放射性同位素和放射性废物的设备、容器，设有电离辐射标志；2)放射性同位素和放射性废物储存场所，设有电离辐射警告标志及必要的文字说明；3)放射诊疗工作场所的入口处，设有电离辐射警告标志；4)诊疗工作场所应当按照有关标准的要求分为控制区、监督区，在控制区进出口及其他适当位置，设有电离辐射警告标志和工作指示灯。掌握“放射诊疗的概念分类及执业条件”知识点。